根据《中华人民共和国消费者权益保护法》，消费者通过合法批准的网络交易平台购买医疗器械，在合法权益受损后，关于权益维护和纠纷解决规则的说法，正确的有
A. 消费者可以向网络交易平台上的销售者要求赔偿
B. 消费者可以向批准网络交易平台服务的审批部门要求赔偿
C. 消费者可以向网络运营安全维护单位要求赔偿
D. 网络平台提供者不能提供销售者的真实名称、地址和有效的联系方式，消费者可以向网络交易平台提供者要求赔偿

正确答案：A、D。消费者可以向网络交易平台上的销售者要求赔偿；网络平台提供者不能提供销售者的真实名称、地址和有效的联系方式，消费者可以向网络交易平台提供者要求赔偿

解析：本题考查《中华人民共和国消费者权益保护法》。根据《中华人民共和国消费者权益保护法》，消费者通过合法批准的网络交易平台购买医疗器械，在合法权益受损后，关于权益维护和纠纷解决规则的说法，正确的有消费者可以向网络交易平台上的销售者要求赔偿（A对）；网络平台提供者不能提供销售者的真实名称、地址和有效的联系方式，消费者可以向网络交易平台提供者要求赔偿（D对）。《中华人民共和国消费者权益保护法》第六章争议的解决第四十四条：消费者通过网络交易平台购买商品或者接受服务，其合法权益受到损害的，可以向销售者或者服务者要求赔偿。网络交易平台提供者不能提供销售者或者服务者的真实名称、地址和有效联系方式的，消费者也可以向网络交易平台提供者要求赔偿；网络交易平台提供者作出更有利于消费者的承诺的，应当履行承诺。网络交易平台提供者赔偿后，有权向销售者或者服务者追偿。网络交易平台提供者明知或者应知销售者或者服务者利用其平台侵害消费者合法权益，未采取必要措施的，依法与该销售者或者服务者承担连带责任。